造成“双排牙”现象的原因可能是
A. 下颌乳中切牙滞留
B. 上颌乳尖牙滞留
C. 第一乳磨牙滞留
D. 乳侧切牙滞留
E. 右下第二乳磨牙滞留

正确答案：A。下颌乳中切牙滞留

解析：本题考查下颌乳中切牙滞留。造成“双排牙”现象的原因可能是下颌乳中切牙滞留（A对）。混合牙列时期，最常见的是下颌乳中切牙滞留，后继之恒中切牙于舌侧萌出，乳牙滞留于唇侧，呈“双排牙”现象。其次常见的是第一乳磨牙的残根和残冠滞留（C错）于萌出的第一前磨牙颊侧或舌侧。第二乳磨牙滞留（E错）多因继承恒牙牙胚的先天缺失或埋伏阻生。但由于乳牙未能按时脱落，又常常使继承恒牙萌出受阻或异位萌出。上颌乳尖牙滞留（B错）、乳侧切牙滞留（D错）一般不会导致“双排牙”现象。